细菌毒力的强弱取决于
A. 细菌侵入的门户
B. 机体抵抗力的强弱
C. 细菌侵入的数量
D. 细菌侵袭力及细菌的毒素
E. 细菌能否产生芽胞

正确答案：D。细菌侵袭力及细菌的毒素

解析：细菌的毒力是由侵袭力和毒素决定的。掌握“医院感染及细菌的致病性”知识点。